以下哪种情况应暂缓拔牙
A. 妊娠的4、5、6月
B. 糖尿病的血糖150mg/dL，尿糖（+）无酸中毒
C. 急性智齿冠周炎伴咬肌间隙感染
D. 甲状腺机能亢进治疗后心率低于100次/min
E. 高血压血压控制在21.3～13.3kPa（160/100mmHg）

正确答案：C。急性智齿冠周炎伴咬肌间隙感染

解析：本题考查系统疾病对牙拔除术的影响及拔牙禁忌证。急性智齿冠周炎伴咬肌间隙感染（C对）应暂缓拔牙。急性智齿冠周炎伴咬肌间隙感染应暂缓拔牙，急性期控制炎症是第一位的，以消炎、镇痛、切开引流、增强全身抵抗力为主；若拔牙会加速感染，导致全身并发症，不利于疾病治疗；应在炎症得到控制以后拔牙。在怀孕的第4、5、6个月（A错）进行拔牙或手术是较为安全的。糖尿病患者空腹血糖控制在8.88mmol/L（160mg/dl）以下可以考虑拔牙，故血糖150mg/dL，尿糖（+）无酸中毒（B错）拔牙属于安全范围。甲状腺功能亢进，静息脉搏低于100次/min（D错），基础代谢率在+20％以下是可以拔牙的。高血压者血压低于180/100mmHg可以考虑拔牙，故血压控制在21.3～13.3kPa（160/100mmHg）（E错）属于安全范围。